对苯巴比妥等镇静剂有一定耐受力的儿童发育阶段是
A. 早产儿
B. 新生儿
C. 婴幼儿
D. 儿童
E. 成年人

正确答案：C。婴幼儿